属于医学道德意识现象的是
A. 医德观念医德情感医德意志医德信念医德理论
B. 评价和调整医务人员行为的准则
C. 医德教育
D. 医德评价
E. 医德修养

正确答案：A。医德观念医德情感医德意志医德信念医德理论

解析：医学道德意识现象是指在医学道德实践活动中形成并影响道德行为的各种具有善恶价值的思想、观点和理论体系，如医学道德观念、医学道德情感、医学道德意志等（A对）。医学道德规范现象是评价医务人员行为的道德标准（B错）。医德教育是通过传授医学道德理念，进而用以指导医务人员的医事行为的活动（C错）。医德评价是人们依据医德理论、原则和规范对医疗卫生机构及医务人员的医德行为所做出的善恶评判（D错）。医学道德修养是医务人员一项重要的医德实践活动，是医务人员在医德品质、情感、意志、习惯等方而按照一定的原则和规范进行自我改造、自我锻炼、自我培养的医德实践过程，以及在此基础上所要达到的医德境界（E错）。